在队列研究中，最常用于分析疾病与危险因素联系强度的指标是
A. RR
B. OR
C. AR
D. PAR
E. P值

正确答案：A。RR